与非处方药西咪替丁同用，可增加出血危险的处方药是
A. 胺碘酮
B. 氟卡尼
C. 华法林
D. 奎尼丁
E. 四环素

正确答案：C。华法林

解析：本题考查药物的联合应用。华法林（C对）与非处方药西咪替丁同用，可增加出血危险。西咪替丁对肝药酶有抑制作用，同用使华法林在体内消除减慢，排出率下降，产生出血危险；胺碘酮（A错）与西咪替丁合用，其血清中浓度升高；氟卡尼（B错）与西咪替丁合用无不良反应；西咪替丁（D错）抑制奎尼丁氧化代谢，提高奎尼丁的浓度，引起中毒；四环素（E错）与西咪替丁合用时溶解速率下降，吸收减少，作用减弱。